女，22岁，半年前诊断为精神分裂症，平时服用利培酮治疗，病情稳定。半月前因与男朋友分手，情绪低落、话少。近3天加重，整日躺在床上，不语不动，拒绝进食，常双眼含泪。家人反复询问下有时能用点头、摇头表示。患者目前首要的处理方法是
A. 认知治疗
B. 加用抗抑郁药
C. 抗精神病药加量
D. 电抽搐治疗
E. 暗示治疗

正确答案：D。电抽搐治疗

解析：成年女性患者，有精神分裂症的病史，情绪低落、话少。近3天加重，整日躺在床上，不语不动，拒绝进食，常双眼含泪。家人反复询问下有时能用点头、摇头表示。综合患者的症状、体征，初步诊断为抑郁障碍（抑郁障碍诊断标准的3条核心症状：①心境低落；②兴趣和愉快感丧；③导致劳累增加和活动减少的精力降低）。患者目前首要的处理方法是电抽搐治疗,不是加抗抑郁药（D对B错）。认知治疗（A错）、暗示治疗（E错）均为辅助性的心理治疗。抗精神病药加量（C错）适用于精神分裂症。